正确的是
A. 只终止在第5～7肋软骨内面
B. 全长前后均有腹直肌鞘包裹
C. 全肌有3～4条腱划
D. 腱划与腹直肌鞘后层结合紧密
E. 上、下宽度均一

正确答案：C。全肌有3～4条腱划

解析：腹直肌上宽下窄，而非上、下宽度均一（E错）。终止在胸骨剑突和第5～7肋软骨的前面，而非只终止在第5～7肋软骨内面（A错）。全肌有3～4条腱划（C对），且在腹直肌的后面，腱划不明显，故腱划与腹直肌鞘后层结合不紧密（D错），全长前后也并非均有腹直肌鞘包裹（B错）。